表面覆盖的是无角化鳞状上皮，上皮钉突数量多，伸入到结缔组织中。该处也是牙龈的弱点的是
A. 牙龈上皮
B. 龈沟上皮
C. 结合上皮
D. 龈谷
E. 附着龈

正确答案：D。龈谷

解析：龈谷表面覆盖的是无角化鳞状上皮，上皮钉突数量多，伸入到结缔组织中。该处也是牙龈的弱点。掌握“牙龈”知识点。